分配纸色谱的固定相是
A. 纤维素
B. 纸
C. 滤纸中所含的水
D. 醇羟基
E. 展开剂中极性小的溶剂

正确答案：C。滤纸中所含的水